对肾的构造描述，错者为
A. 肾实质分皮质和髓质2部分
B. 每侧肾有15~20个肾锥体
C. 每侧肾有7~8个肾小盏
D. 每肾约有5~6个肾盂
E. 无

正确答案：D。每肾约有5~6个肾盂

解析：肾实质分为肾皮质和肾髓质（A对），每侧肾有15 ~20个肾锥体（B对），7~8个肾小盏（C对），1个肾盂（D错，为本题正确答案）。